随访急性白血病患者的5年生存率，下述哪种情况不属于删失
A. 死于白血病
B. 失访
C. 5年后仍存活
D. 死于交通事故
E. 死于脑卒中

正确答案：A。死于白血病

解析：本题考查删失数据的原因。删失数据产生原因包括：失访、退出、终止。在急性白血病患者的生存率分析中，死于白血病（A对BCDE错）不属于删失。